某肺心病患者伴水肿应用速尿治疗，血气分析结果如下pH7.34,HCO₃⁻41mmol/LPaCO₂8.8kPa(66mmHg),Na⁺140mmol/L,CL⁻75mmol/L,其酸碱紊乱类型为
A. 呼吸性酸中毒
B. 代谢性碱中毒
C. 呼吸性酸中毒合并代谢性碱中毒
D. 呼吸性酸中毒合并AG正常性代谢性酸中毒和代谢性碱中毒
E. 呼吸性酸中毒合并AG增高性代谢性酸中毒和代谢性碱中毒

正确答案：E。呼吸性酸中毒合并AG增高性代谢性酸中毒和代谢性碱中毒

解析：pH7.34<7.35可判定为酸中毒，引起酸中毒的原因可能有PaCO₂增高或HCO3-下降，由于患者PaCO₂（正常范围为33~46 mmHg）上升，故可判断为呼吸性酸中毒，根据单纯型酸碱平衡紊乱的代偿公式，PaCO₂每增高1 mmHg，HCO₃⁻增高0.35 mmol/L，该患者PaCO₂增高66-40=26 mmHg，HCO₃⁻应增高26×0.35=9.1±3 mmol/L，患者如是单纯型呼吸性酸中毒，HCO₃⁻应为24+9.1±3=30.1~36.1 mmol/L，患者HCO₃⁻为41mmo1/L高于代偿值，表明患者是呼吸性酸中毒合并代谢性碱中毒，为混合型酸碱平衡紊乱。AG= Na+- (HCO₃⁻+Cl-）=24 mmo1/L>16 mmo1/L,提示患者存在AG增高性代谢性酸中毒，所以患者是呼吸性酸中毒合并AG增高性代谢性酸中毒和代谢性碱中毒（E对）。